有效氯是指含氯化合物分子团中氯的价数
A. ＞+1价
B. ＜-1价
C. ＞-1价
D. ＞-2价
E. ＞-3价

正确答案：C。＞-1价

解析：本题考查有效氯。含氯化合物中具有杀菌能力的有效成分称为有效氯，含氯化合物分子团中氯的价数＞-1价（C对ABDE错）者均为有效氯。